哪个不是髋骨的结构
A. 坐骨大切迹
B. 耻骨梳
C. 髂前上棘
D. 弓状线
E. 臀肌粗隆

正确答案：E。臀肌粗隆

解析：臀肌粗隆属于股骨的结构（E错，为本题正确答案）。坐骨大切迹（A对）、耻骨梳（B对）、髂前上棘（C对）、弓状线（D对）均属于髋骨。